最易发生恶变的色素痣是
A. 皮内痣
B. 复合痣
C. 交界痣
D. 雀斑样色素痣
E. 毛痣

正确答案：C。交界痣

解析：交界痣：痣细胞在表皮和真皮交界处，呈多个巢团状，边界清楚，分布距离均匀；每一巢团的上一半在表皮的底层内，下一半则在真皮浅层内。这些痣细胞为大痣细胞，色素较深。突起于皮肤表面的交界痣容易受到洗脸、刮须、摩擦与损伤的刺激，并由此可能发生恶性症状恶性黑色索瘤多来自交界痣。掌握“色素痣”知识点。